肾功能不全的慎用的是
A. 苦杏仁
B. 艾叶
C. 雷公藤
D. 忍冬藤
E. 夜交藤

正确答案：C。雷公藤

解析：本题考查的是常见对肾功能有影响的中药。肾功能不全的慎用的是雷公藤（C对）。常见对肾功能有影响的植物类中药：（1）含生物碱类：近年来发现，不但雷公藤、草乌、益母草、蓖麻子、麻黄、北豆根等均可导致急性肾功能衰竭，而且含上述中药的一些制剂也可引起肾损害甚至急性肾功能衰竭。临床应用要严格控制用药剂量和用药天数，并加强肾功能监测，对已有肾功能不全者禁用雷公藤制剂，慎用昆明山海棠片（2）含马兜铃酸类：马兜铃、天仙藤、寻骨风等均含马兜铃酸，中毒可致肾小管坏死出现面部浮肿，渐至全身水肿、尿频尿急，甚至出现急、慢性肾功能衰竭及尿毒症而死亡。（3）含挥发油类：部分芳香类药物的肾毒性可能与其挥发油类成分相关，如土荆芥、藿香、茵陈、艾叶（B错）等。（4）含蒽醌类：研究显示，大黄蒽醌类成分（大黄、番泻叶、芦荟）具有潜在的肝肾毒性和致癌性。（5）苷类：苍耳子含苍术苷或羧基苍术苷可导致近端肾小管坏死、肝中心小叶坏死。苦杏仁（A错）不良反应表现：苦杏仁的主要成分苦杏仁苷是其有效成分也是中毒成分，误服过量苦杏仁可发生氢氰酸中毒，使延髓等生命中枢先抑制后麻痹，并抑制细胞色素氧化酶的活性而引起组织窒息。临床表现为眩晕、心悸、恶心、呕吐等中毒反应，重者出现昏迷、惊厥、瞳孔散大、对光反应消失，最后因呼吸麻痹而死亡。忍冬藤（D错）和夜交藤（E错）的不良反应表现，2022年考试指南未明确说明。